女，35岁。“骨盆粉碎性骨折”手术后1天突发胸痛，伴呼吸困难、濒死感。查体：P110次/分，R40次/分，BP85/65mmHg，口唇发绀，双肺未闻及干湿性啰音，心率110次/分，心律齐，P₂亢进，各瓣膜听诊区未闻及杂音。D-二聚体0.85mg/L。为明确诊断应首选的检查是
A. 超声心动图
B. 心电图
C. 肺动脉CT
D. 胸部X线片
E. 动脉血气分析

正确答案：C。肺动脉CT

解析：患者骨盆骨折术后（PTE常见危险因素），胸痛、呼吸困难、濒死感（PTE常见症状）。心率快，呼吸快，血压低（休克），P₂亢进（肺动脉高压），D-二聚体（高，正常值0-0.256mg/L）（提示血栓形成）。因此最可能为PTE。明确诊断应首选的检查是肺动脉CT（C对）。其余选项（ABDE错）均为疑诊的检查。